下列关于相对数表述正确的是
A. 治疗2人治愈1人，其治愈率为50％
B. 构成比和率的作用是相同的
C. 几个组的率可直接相加求平均率
D. 内部构成比影响总率比较时要作率的标准化
E. 两个样本率不同，则其总体率亦一定不同

正确答案：D。内部构成比影响总率比较时要作率的标准化